某患者，46（牙合）面大面积龋坏，要求修复，检查46探（-），叩（++），46根尖部牙龈上有瘘道，牙周结石Ⅱ度牙龈红肿，在修复前准备工作中，不必要的是
A. X线牙片
B. 牙周治疗
C. 根管治疗
D. 曲面断层片
E. 给患者讲明治疗方案

正确答案：D。曲面断层片

解析：本题考查修复前准备。患牙46牙体缺损，选择X线牙片即可，无需拍摄曲面断层片（D错，为本题正确答案）。